染色体检查结果为t（15；17）的白血病类型
A. AML-M₃
B. AML-M₂
C. CML
D. AML-M₅
E. ALL

正确答案：A。AML-M₃

解析：染色体检查结果为t（15；17）的白血病类型为AML-M₃（急性早幼粒细胞白血病）（A对），为其特异的染色体核型变化。AML-M₂（急性粒细胞白血病部分分化型）（B错）的特异染色体核型变化为t（8；21）；CML（慢性髓系白血病）（P577）（C错）特异的染色体核型变化为t（9；22）；AML-M₅（急性单核细胞白血病）（D错）、ALL（急性淋巴细胞白血病）（E错）的染色体核型不会出现t（15；17）的变化。